韩某，男，68岁。肺心病多年，诊见：呼吸浅短难续，声低气怯，甚则张口抬肩，倚息不能平卧，咳嗽，痰白清稀如沫，胸闷，心慌形寒，汗出，舌淡，脉沉细微无力。治疗应首选的方剂是
A. 苏子降气汤
B. 生脉散合血府逐瘀汤
C. 补肺汤
D. 涤痰汤
E. 小青龙汤

正确答案：C。补肺汤

解析：本病患者有肺心病，肺虚及肾，金不生水，肺不主气，肾不纳气。肺肾两虚，不能主气、纳气，故呼吸浅短，声低气怯，张口抬肩，不能平卧；寒饮伏肺，肾虚水泛则咳痰色白如沫，咯吐不利；肺病及心，心气虚弱，故心慌形寒，汗出；肺失治节，气不帅血，气滞血瘀，则见舌淡，脉沉细虚微无力，所以宜用补肺汤（C对）；苏子降气汤用于肺心病的痰浊壅肺证，症状：咳嗽痰多，色白黏腻或呈泡沫样，短气喘息，稍劳即著，脘痞纳少，倦怠乏力，舌质偏淡，苔薄腻或浊腻，脉滑（A错）；生脉散合血府逐瘀汤用于气虚血瘀证，症状：喘咳无力，气短难续，痰吐不爽，心悸，胸闷，口干，面色晦暗，唇甲发绀，神疲乏力，舌淡黯，脉细涩无力（B错）；涤痰汤用于痰蒙神窍证，症状：神志恍惚，谵语，烦躁不安，撮空理线，表情淡漠，嗜睡，昏迷，或肢体瞤动，抽搐，咳逆，喘促，咳痰不爽，苔白腻或淡黄腻，舌质暗红或淡紫，脉细滑数（D错）；小青龙汤用于寒饮伏肺证，症状：咳逆喘息不得卧，痰多稀薄，恶寒发热，背冷无汗，渴不多饮，或渴喜热饮，面色青晦，舌苔白滑，脉弦紧（E错）。